具有清热，解毒，养阴功效的药物是
A. 玄参
B. 赤芍
C. 紫草
D. 生地黄
E. 牡丹皮

正确答案：A。玄参

解析：玄参的功效是清热凉血，滋阴降火，解毒散结（A对）。赤芍（B错）的功效是清热凉血，散瘀止痛。紫草（C错）的功效是清热凉血，活血解毒，透疹消斑。生地黄（D错）的功效是清热凉血，养阴生津。牡丹皮（E错）的功效是清热凉血，活血化瘀。